醋酸地塞米松注射液的含量测定方法是
A. 荧光分析法
B. 紫外分光光度法
C. 酸性染料比色法
D. 四氮唑比色法
E. 高效液相色谱法

正确答案：D。四氮唑比色法